不适用于根管荡洗的溶液有
A. 3%的双氧水
B. 30%双氧水
C. 5.25%次氯酸钠
D. 2%氯亚明
E. 生理盐水

正确答案：B。30%双氧水

解析：本题考查根管清理与成形。30%双氧水（B错，为本题正确答案）一般是工业用。可用氧化剂、漂白剂、消毒剂、脱氯剂，并供火箭燃料、有机或无机过氧化物、泡沫塑料和其他多孔物质等，但是不适用于根管荡洗。用于根管清理的双氧水浓度为3%左右。